男性，28岁，因江水泛滥，饮用江水，突然出现剧烈腹泻，随后呕吐，由水样物转为“米泔水”样物，最可能的诊断是
A. 金葡菌胃肠炎
B. 急性细菌性痢疾
C. 大肠杆菌性肠炎
D. 病毒性肠炎
E. 霍乱

正确答案：E。霍乱